男，32岁。突发上腹剧痛2小时，蔓延至右下腹及全腹，既往有“胃痛”病史10余年，未诊治。查体：板状腹，压痛、反跳痛（+），肝浊音界消失。初步诊断应首先考虑
A. 绞窄性肠梗阻
B. 急性阑尾炎合并穿孔
C. 急性出血坏死性胰腺炎
D. 急性胆囊炎合并穿孔
E. 胃十二指肠溃疡急性穿孔

正确答案：E。胃十二指肠溃疡急性穿孔

解析：青年男性患者，有胃痛病史，2小时前突发上腹剧痛，腹部压痛、反跳痛，板状腹（腹膜刺激征，提示急性腹膜炎），肝浊音界消失（提示空腔脏器破裂），结合患者病史、体查，应考虑为胃十二指肠溃疡急性穿孔（E对）。绞窄性肠梗阻（P361）（A错）主要表现为突发的剧烈腹痛、呕吐，伴腹胀和排气排便停止等表现，查体可触及腹部肿块；急性阑尾炎（P371）一般症状较轻，典型表现为转移性右下腹疼痛，穿孔后腹痛可暂时减轻（B错）；急性出血坏死性胰腺炎（P458）（C错）常发生于饱餐或饮酒后，主要表现为左上腹疼痛、腹胀、恶心、呕吐及腹膜刺激症状，腹痛可向左肩及左腰背部放射；急性胆囊炎主要表现为右上腹绞痛或持续性疼痛伴阵发性加剧，疼痛向右肩放射，查体右上腹局部压痛、反跳痛，可触及肿大的胆囊，Murphy征阳性，穿孔后可有腹膜刺激症状（D错），上述疾病均不会出现肝浊音界消失。